1020028”的错误解释是
A. 这是一个药用辅料的批准文号
B. 11是北京市的行政区划代码
C. 这是2002年核发的
D. 其顺序号为0028
E. 由国家卫生部药政司批准的

正确答案：E。由国家卫生部药政司批准的